关于绷带包扎的注意事项，以下哪一项是不正确的
A. 骨折复位后的创口包扎，应注意防止错位
B. 感染创口要防止再污染，引流应保持通畅
C. 腮腺区创口的包扎，应施以一定压力，以免发生涎瘘
D. 包扎颌下区和颈部时，应保持呼吸道通畅，防止压迫喉头和气管
E. 脓肿切开引流后的包扎不应有任何的压力

正确答案：E。脓肿切开引流后的包扎不应有任何的压力

解析：本题考查绷带包扎的注意事项。关于绷带包扎的注意事项，脓肿切开引流后的包扎不应有任何的压力（E错，为本题正确答案）是不正确的。对于切开引流的创口，第一次包扎应加以适当压力，以利止血，以后换药包扎时，应注意引流通畅，而不宜过紧。颌面颈部创口的包扎，应根据创口所在部位的解剖特点，结合创口的性质和手术要求，综合考虑以下几点：1.清洁创口在包扎时，应注意无菌操作，覆盖的无菌纱布，应有一定的厚度和范围。感染创口也要防止其再污染，保持引流通畅（B对）。2.绷带在包绕下颌下区和颈部时，应特别注意保持呼吸道通畅，防止压迫喉头和气管（D对）。3.包扎应该平整、贴合、松紧适度。4.腮腺区创口的包扎，应施以一定压力，并应富于弹性，以免发生涎瘘（C对）。5.对于切开引流的创口,第一次包扎应加以适当压力，以利止血。以后换药包扎时，应注意引流通畅，而不宜过紧。6.整形手术后的创口包扎，压力不宜过大+以免影响组织血运。7.骨折复位后的创口包扎，应注意防止错位（A对）。